影响健康教育与健康促进的效果评价的因素有
A. 历史性原因
B. 工作人员与参与者的熟练性
C. 失访
D. 以上各项均是
E. 以上各项均错

正确答案：D。以上各项均是